慢性肾功能不全继发性甲旁亢患者应给予
A. 糖皮质激素
B. 磷结合剂
C. 促红细胞生成素
D. 血管紧张素转换酶抑制剂
E. 碳酸氢钠

正确答案：B。磷结合剂

解析：慢性肾功能不全时，肾小球滤过率降低，尿磷排出减少，血磷浓度升高。高血磷与血钙结合导致异位软组织钙化，并使血钙降低，刺激甲状旁腺分泌大量的甲状旁腺素（甲状旁腺素可以升高血钙、降低血磷），引起继发性甲旁亢。因此，应在限制磷的摄入的基础上，给予磷结合剂（B对）进行治疗。糖皮质激素（九版药理学P329-P332）（A错）因其具有抗炎、抗休克等作用，主要用于感染、炎症、休克等疾病的治疗。促红细胞生成素（P524）（C错）主要用于肾性贫血的治疗。血管紧张素转换酶抑制剂（九版药理学P203）（D错）主要用于高血压、充血性心力衰竭、急性心肌梗死、糖尿病肾病等的治疗。碳酸氢钠（P516）（E错）主要用于酸中毒的治疗。